一岁小儿头围测量为36cm，应考虑哪种疾病
A. 营养不良
B. 脑积水
C. 脑发育不良
D. 甲状腺功能减低症
E. 佝偻病

正确答案：C。脑发育不良

解析：正常新生儿初生时头围约34cm，在生后的前3个月和后9个月头围都增长约6cm，故1岁时达46cm，头围过大，常见于脑积水；头围过小，可见于头小畸形或脑发育不全。故此题选择C项。掌握“体格生长常用指标”知识点。